阿霉素
A. 对心脏的影响最大
B. 对肾脏的影响最大
C. 对肺脏毒性最大
D. 对骨髓抑制最重
E. 发生腹泻最重

正确答案：A。对心脏的影响最大

解析：阿霉素是干扰转录过程和阻止RNA合成的抗肿瘤药物，其抗瘤谱广，疗效高，主要用于对常用抗肿瘤药耐药的急性淋巴细胞白血病或粒细胞白血病、恶性淋巴肉瘤、乳腺癌等。其最严重的毒性反应为心肌退行性变和心肌间质水肿的心脏毒性（A对），可用右雷佐生作为化学保护剂来预防心脏毒性的发生。对肾脏的影响最大（B错）为顺铂的不良反应。对肺脏毒性最大（C错），较少有药物对肺脏产生毒性。对骨髓抑制最重（D错）为环磷酰胺。发生腹泻最重（E错）较少有抗肿瘤药物引起腹泻。